下列关于脂溶性的说法错误的是
A. 经简单扩散方式转运的外源化学物必须具有脂溶性。
B. 脂/水分配系数指的是当一种物质在脂相和水相之间的分配达到平衡时，其在脂相和水相中溶解度的比值。
C. 外源化学物的脂/水分配系数越大，越易溶解于脂肪，经简单扩散转运的速率也就越慢。
D. 弱有机酸在酸性环境中、弱有机碱在碱性环境中多处于非解离态，易于透过生物膜转运。

正确答案：C。外源化学物的脂/水分配系数越大，越易溶解于脂肪，经简单扩散转运的速率也就越慢。

解析：本题考查脂溶性的相关内容。简单扩散又称脂溶扩散，是大多数化学毒物通过生物膜的方式。经简单扩散方式转运的外源化学物必须具有脂溶性（A对）。脂溶性的高低可用脂/水分配系数表示，即当一种物质在脂相和水相之间的分配达到平衡时，其在脂相和水相中溶解度的比值（B对）。一般情况，化学毒物的脂/水分配系数越大，越易溶解于脂肪，经简单扩散转运的速率也就越快（C错，为本题正确答案）。弱有机酸在酸性环境中、弱有机碱在碱性环境中多处于非解离态，易于透过生物膜转运（D对）。